（牙合）面两牙尖三角嵴斜形相连形成的嵴称为
A. 切嵴
B. 边缘嵴
C. 横嵴
D. 斜嵴
E. 牙尖嵴

正确答案：D。斜嵴

解析：斜嵴：（牙合）面两牙尖三角嵴斜形相连形成的嵴。掌握“牙的萌出、更替及牙体解剖名词、标志”知识点。